土炒山药的炮制作用是
A. 增强健脾和胃作用
B. 增强补脾止泻作用
C. 增强健脾消胀作用
D. 增强补肾强骨作用
E. 增强益肺润燥作用

正确答案：B。增强补脾止泻作用

解析：本题考查的是山药的炮制作用。土炒山药的炮制作用是增强补脾止泻作用（B对）。山药：【炮制作用】山药味甘，性平，归脾、胃、肾经。具有补脾益胃，生津益肺，补肾涩精的功能。①山药以补肾生精，益肺阴为主。用于肾虚遗精、尿频，肺虚喘咳，阴虚消渴。②土炒山药以补脾止泻为主，用于脾虚久泻。③麸炒山药以补脾健胃为主（A错）。用于脾虚食少，泄泻便溏，白带过多。增强健脾消胀作用（C错）为麸炒白术的炮制作用。麸炒白术，借麸味甘入中之性，以缓和白术的燥性，增其健脾之功，并兼消胀之能。用于脾气虚弱、中焦不和、运化失常所致的食少胀满、倦怠乏力。增强补肾强骨作用（D错）为骨碎补的炮制作用。骨碎补：【炮制作用】骨碎补味苦，性温。归肝、肾经。具有疗伤止痛、补肾强骨的功能。骨碎补密被鳞片，不易除净，且质地坚硬而韧，不利于粉碎和煎煮出有效成分，故临床多用其炮制品。砂炒骨碎补，质地松脆，易于除去鳞片，便于调剂和制剂，有利于煎出有效成分，以补肾强骨、续伤止痛为主。增强益肺润燥作用（E错）为阿胶的炮制作用。阿胶：【炮制作用】阿胶味甘，性平。归肺、肝、肾经。具有补血滋阴，润燥，止血的功能。用于血虚萎黄，眩晕心悸，肌萎无力，心烦不眠，虚风内动，肺燥咳嗽，劳嗽咯血，吐血尿血，便血崩漏，妊娠胎漏。①蛤粉炒阿胶降低了滋腻之性，长于益肺润燥，质变酥脆，利于粉碎，同时也矫正了不良气味。用于阴虚咳嗽，久咳少痰或痰中带血。②蒲黄炒阿胶以止血安络力强，多用于阴虚咳血，崩漏，便血。